常用口腔健康教育方法不包括
A. 个别交谈
B. 组织小型讨论会
C. 组织社区活动
D. 中小学校口腔流行病学调查
E. 借助大众传播渠道

正确答案：D。中小学校口腔流行病学调查

解析：口腔健康教育的方法：①大众传媒；②社区活动；③小型讨论会；④个别交谈。掌握“口腔健康教育”知识点。